某乡4万人，约1万户，欲抽其1／10人口进行某病调查。随机抽取第1户，随后每隔4户抽取1户，抽到户的每个成员均进行调查。这种抽样方法称为
A. 分层抽样
B. 系统抽样
C. 整群抽样
D. 简单抽样
E. 多级抽样

正确答案：B。系统抽样

解析：“随机抽取第1户，随后每隔4户抽取1户，抽到户的每个成员均进行调查”为系统抽样（B对）。